关于中指的运动，正确的是
A. 第2骨间掌侧肌使其内收
B. 第2蚓状肌使手指间关节屈张
C. 第3骨间掌侧肌使其外展
D. 第2骨间背侧肌使其外展
E. 第3骨间背侧肌使其内收

正确答案：D。第2骨间背侧肌使其外展

解析：关于中指，不受第2骨间掌侧肌控制（A错），也不受第3骨间掌侧肌控制（C错），使其手指间关节屈张的是第3蚓状肌，而非第2蚓状肌（B错），第2骨间背侧肌使其外展（D对），而非内收（E错）。